饮茶型地方性氟中毒病区的划分是依据下列哪个人群中氟骨症的患病率来确定
A. 26～35周岁
B. 36～45周岁
C. 46～55周岁
D. 56～65周岁
E. 65岁以后

正确答案：B。36～45周岁

解析：本题考查饮茶型地方性氟中毒病区的划分。饮茶型地方性氟中毒病区的划分是依据36～45周岁（B对ACDE错）人群中氟骨症的患病率来确定的。可分为：①轻度病区：经X线检查，36～45周岁人群中没有中度及以上氟骨症发生；②中度病区：经X线检查，36～45周岁人群中中度及以上氟骨症患病率≤10%；③重度病区；经X线检查，36～45周岁人群中中度及以上氟骨症患病率＞10%。